味甘性温，不宜与热茶同服的药是热茶同服的药是
A. 贯众
B. 雷丸
C. 槟榔
D. 使君子
E. 苦楝皮

正确答案：D。使君子

解析：本题考查的是使君子的性味归经和使用注意。味甘性温，不宜与热茶同服的药是热茶同服的药是使君子（D对）。使君子：【性味归经】甘，温。归脾、胃经。【使用注意】本品大量服用可致呃逆、眩晕、呕吐等不良反应，故不宜超量服。若与热茶同服，亦可引起呃逆，故服药时忌饮茶。贯众（A错）：【性味归经】苦，微寒。有小毒。归肝、胃经。【使用注意】本品苦寒有小毒，故孕妇及脾胃虚寒者慎服。雷丸（B错）：【性味归经】苦，寒。有小毒。归胃、大肠经。【使用注意】本品苦寒，脾胃虚寒者慎服。其杀虫成分为蛋白酶，受热（60℃左右）或酸作用下易被破坏失效，而在碱性环境中使用则作用最强，故入煎剂无驱绦虫作用。槟榔（C错）：【性味归经】苦、辛，温。归胃、大肠经。【使用注意】本品行气、缓通大便，故脾虚便溏及气虚下陷者不宜服。苦楝皮（E错）：【性味归经】苦，寒。有毒。归脾、胃、肝经。【使用注意】本品苦寒有毒，能伤胃损肝，故不宜过量或持续服用，脾胃虚寒、肝病患者、孕妇慎服。